关于拔牙创的检查与处理错误的是
A. 检查拔除的牙根是否完整
B. 检查牙龈是否撕裂
C. 检查牙槽窝，如有异物应清除
D. 过高的牙槽中隔应待自行吸收
E. 压迫复位牙槽窝

正确答案：D。过高的牙槽中隔应待自行吸收

解析：本题考查拔牙创的检查与处理。关于拔牙创的检查与处理错误的是过高的牙槽中隔应待自行吸收（D错，为本题的正确答案）。牙拔除后，拔牙窝的处理：①检查拔除的牙根是否完整（A对）、数目是否符合该牙的解剖规律；②检查牙龈是否撕裂（B对），撕裂的牙龈组织应予缝合，连续拔除多个牙时，牙龈可能游离外翻应拉拢缝合；③用刮匙检查牙槽窝，如有异物应清除（C对），以免导致疼痛、出血，但乳牙拔除后不要搔刮牙槽窝，以免伤及恒牙胚；④检查牙槽骨有无折断，与骨膜牙龈相连的骨折片应复位保留，基本游离者则取出；⑤过高的牙槽中隔应加以修整，以免影响后期义齿修复；⑥扩大的牙槽窝需要压迫复位（E对），便于创口愈合。